男，30岁。被膜下脾破裂2小时，不口渴，入院后排尿一次，约300ml，未见肉眼血尿。查体：P96次/分，BP90/65mmHg。为迅速改善组织灌注，应首选
A. 红细胞悬液
B. 新鲜冰冻血浆
C. 平衡盐液
D. 全血
E. 羟乙基淀粉溶液

正确答案：C。平衡盐液

解析：患者脾破裂，引发失血性休克。为迅速改善组织灌注，补充血容量应首选平衡盐液（C对）。